畸形中央尖多见于
A. 中切牙
B. 侧切牙
C. 尖牙
D. 前磨牙
E. 磨牙

正确答案：D。前磨牙

解析：畸形中央尖多见于前磨牙，单侧或对称发生，偶见发生于磨牙、尖牙和切牙。掌握“畸形中央尖”知识点。